在胸骨左缘第3、4肋间触及收缩期震颤，应考虑为
A. 主动脉瓣关闭不全
B. 室间隔缺损
C. 二尖瓣狭窄
D. 三尖瓣狭窄
E. 肺动脉瓣狭窄

正确答案：B。室间隔缺损

解析：心脏震颤是用手在心前区触及的一种微细的震动感，是器质性心血管疾病的特征性体征之一，能触及震颤的心血管疾病主要是某些先天性心脏病及心脏瓣膜狭窄，瓣膜关闭不全少见（A错）。胸骨左缘第3、4肋间触及收缩期震颤见于室间隔缺损（B对），胸骨右缘第2肋间触及收缩期震颤见于主动脉狭窄，胸骨左缘第2肋间触及收缩期震颤见于肺动脉狭窄（E错），胸骨左缘第2肋间触及连续性震颤见于动脉导管未闭，心尖区舒张期震颤见于二尖瓣狭窄（C错），心尖区收缩期震颤见于重度二尖瓣关闭不全。三尖瓣狭窄（D错）较少出现震颤。